下列关于合理用药的叙述，错误的是
A. 晚期癌症患者即使不疼也按时服硫酸吗啡片
B. 合理用药的前提条件必须是合法用药
C. 合理用药应该建立在循证药物信息的基础上
D. 合理用药的生物医学标准包括病人依从性良好
E. 给麻醉药品成瘾患者继续使用麻醉药品

正确答案：E。给麻醉药品成瘾患者继续使用麻醉药品